妊娠早期,恶心呕吐,呕吐食物或清涎,食入即吐,不思饮食,头晕体倦,舌淡苔白，脉缓滑无力。其证候是
A. 脾虚证
B. 肝郁证
C. 肝胃不和证
D. 脾胃虚弱证
E. 气阴两伤

正确答案：D。脾胃虚弱证

解析：患者妊娠早期,恶心呕吐,呕吐食物或清涎,食入即吐应考虑为恶阻，不思饮食，头晕体倦,舌淡苔白，脉缓滑无力，为恶阻脾胃虚弱证；脾胃素虚，升降失常，孕后阴血下聚养胎，冲气上逆犯胃，胃失和降，故恶心呕吐，甚则食入即吐，中阳不振，清阳不升，则头晕体倦，舌淡，苔白，脉缓滑无力为脾胃虚弱之征（D对）。妊娠恶阻肝胃不和证会出现呕吐苦水或酸水，胸满胁痛，嗳气叹息，头胀而晕，烦渴口苦的症状（C错）。